引起发热最常见的原因是
A. 细菌感染
B. 无菌坏死物质的吸收
C. 抗原﹣抗体反应
D. 内分泌疾病与代谢障碍
E. 体温调节中枢功能失常

正确答案：A。细菌感染